坐骨
A. 坐骨结节位置最低，可在体表扪到
B. 体组成髋臼后下1/5
C. 小切迹位于坐骨棘上方
D. 大切迹是坐骨的一部分
E. 坐骨支是坐骨结节伸出的粗大的骨板

正确答案：A。坐骨结节位置最低，可在体表扪到

解析：坐骨结节, 是坐位时体重的承受点，为坐骨最低部，可在体表扪及（A对）。坐骨分坐骨体和坐骨支，体组成髋臼的后下 2/5（B错），后缘有突起的坐骨棘, 棘下方为坐骨小切迹（C错），坐骨棘与骼后下棘之间为坐骨大切迹（D错）。坐骨体下后部向前、上、内延伸为较细的坐骨支，其末端与耻骨下支结合（E错）。